人与环境之间的关系是
A. 环境决定人类
B. 人类改造环境
C. 互为因果
D. 互相联系、相互作用和制约的关系
E. 无特殊关系

正确答案：D。互相联系、相互作用和制约的关系

解析：本题考查人与环境的辩证统一关系。人与环境的关系是生物发展史上长期形成的一种既相互对立、相互制约又相互依存、相互转化的辩证统一关系（D对ABCE错）。人与自然界息息相通，密不可分，自然界的变化可以直接或间接影响人类。人类既是环境的产物，也是环境的塑造者。人类的生产和生活活动需要不断地向周围环境获取物质和能量，以求自身的生存和发展，同时又将废弃物排放于环境。